患儿，男，5岁，体重25kg，有癫痫病史，青霉素过敏史。因急性胆囊炎合并腹腔感染住院治疗，体征和实验室检查：白细胞计数15.8×10³/L，体温39.5℃，肝、肾功能正常，医师处方美罗培南静脉滴注（说明书规定儿童剂量为一次20mg/kg）。用药过程中，应密切监视的不良反应是
A. 前庭神经功能障碍
B. 承重关节损伤
C. 日光性皮炎
D. 视网膜神经炎
E. 中枢神经系统症状

正确答案：E。中枢神经系统症状

解析：本题考查药物的不良反应。美罗培南属碳青霉素类，具有抗菌谱广、抗菌活性强和对β-内酰胺酶高度稳定的特点。碳青霉烯类药尤其是亚胺培南、西司他丁可引起中枢神经系统（E对）严重不良反应，如肌阵挛、精神障碍，包括幻觉、错乱状态或癫痫发作等。